初产妇，30岁。孕37周，规律宫缩3小时。产科检查宫口开大2cm，臀先露，S=－2。2分钟前胎膜自然破膜，胎心监护显示胎心率90次/分，阴道内诊触及搏动条索状物，最恰当的处理措施是
A. 采取头低臀高位，立即行剖宫产术
B. 吸氧，胎心恢复后立即行剖宫术
C. 行外转胎位术后待自然分娩
D. 静脉滴注缩宫素，宫口开全行臀牵引
E. 行内转胎位术后待自然分娩

正确答案：A。采取头低臀高位，立即行剖宫产术

解析：青年初产妇，孕37周，宫口开大2cm（宫口未开全），胎儿在坐骨棘平面以上2cm（S＝－2），胎膜已破，臀先露，胎心率90次/分（＜100bpm），出现了胎儿窘迫，由于宫口未开全，故最恰当的措施是采取头低臀高位，立即行剖宫产术（A对）。行外转胎位术后待自然分娩（P204）（C错）因有发生胎盘早剥、脐带缠绕等严重并发症的可能，较少使用。吸氧，胎心恢复后立即行剖宫术（B错）、静脉滴注缩宫素，宫口开全行臀牵引（D错）、行内转胎位术后待自然分娩（E错）不能及时终止妊娠，易导致胎儿结局不良。